患者，男性，60岁，腹股沟部出现可复性肿物1个月，可降入阴囊，应首先考虑的诊断是
A. 腹股沟直疝
B. 腹股沟斜疝
C. 股疝
D. 难复性疝
E. 嵌顿疝

正确答案：B。腹股沟斜疝

解析：患者老年男性，腹部有肿块反复脱出，腹股沟斜疝多见于儿童和青中年男性，包括易复性斜疝、难复性斜疝、嵌顿性斜疝、绞窄性斜疝，其中易复性疝为腹股沟区出现可复性肿块，站立或负重时出现，平卧休息或用手推送，肿块可回纳腹腔（B对）。腹股沟直疝常见于年老体弱者。表现为患者直立时，在腹股沟内侧端，耻骨结节上外方出现一半球形肿块，肿块较软，可无任何症状。直疝囊颈宽大，平卧后疝内容物常自行复位，站立时鼓出，鸽蛋大小。直疝绝不进入阴囊，极少发生嵌顿（A错）。股疝常在腹股沟韧带下方卵圆窝处出现一半球形肿块，一般约核桃大小，除部分病人在久站或咳嗽时感到患处胀痛外，无明显其他症状，尤其肥胖病人易被忽视（C错）。难复性斜疝除坠胀感、牵引痛稍重外，其主要表现为包块不能完全回纳，尚有消化不良和便秘等症状（D错）。嵌顿疝常发生在高强度劳动或剧烈咳嗽及严重便秘等腹内压骤增时，主要表现为包块突然增大，伴有明显疼痛，包块变硬无弹性，触痛明显，不能回纳（E错）。